妊娠合并慢性肾炎肾阳虚证治疗方剂为
A. 白术散
B. 防己黄芪汤
C. 生脉散
D. 真武汤
E. 猪苓汤

正确答案：D。真武汤

解析：妊娠合并慢性肾炎肾虚证因肾阳虚衰，气化不利，水气内停，小便不利所致。治宜温阳补肾利水，方用温阳利水的真武汤（D对）。防己黄芪汤（B错）主治表虚风水或水湿；猪苓汤（E错）主治水热互结伤阴证；白术散（A错）功效为燥湿和胃，温肾健脾，主治妊娠合并慢性肾炎脾虚湿盛证；生脉散（C错）功用益气生津，敛阴止汗。